直接固位体主要指的是
A. 卡环
B. 腭板
C. 基托
D. （牙合）支托
E. 以上均正确

正确答案：A。卡环

解析：本题考查局部义齿人工牙及基托。直接固位体：直接固位体主要是卡环（A对），将卡环置于基牙的倒凹区，利用卡环的弹性起固位作用，是目前广泛应用的固位体。其主要作用是固位、稳定和支持。